足太阴脾经的公孙穴位于
A. 第一跖骨趾关节部，赤白肉际处
B. 第一跖骨小头前缘，赤白肉际处
C. 第一跖骨小头后缘，赤白肉际处
D. 第一跖骨基底部后下方，赤白肉际处
E. 第一跖骨基底部前下方，赤白肉际处

正确答案：E。第一跖骨基底部前下方，赤白肉际处

解析：公孙穴为脾经络穴，在跖区，第一跖骨基底部前下方，赤白肉际处（E对）。